抗结核病的一线用药
A. 异烟肼
B. 庆大霉素
C. 利福平
D. 乙胺丁醇
E. 吡嗪酰胺

正确答案：A、C、D、E。异烟肼；利福平；乙胺丁醇；吡嗪酰胺

解析：本题考查抗结核药。第一线抗结核病药：包括异烟肼（A对）、利福平（C对）、乙胺丁醇（D对）、吡嗪酰胺（E对）、链霉素等为常用抗结核病药，临床疗效好、不良反应少。庆大霉素（B错）是氨基糖苷类抗生素。